根据《互联网药品交易服务审批暂行规定》，向个人消费者提供互联网药品交易服务的企业，应当具备的条件不包括
A. 依法开办的药品连锁零售企业
B. 获得国务院药品监管部门的批准
C. 具备与上网交易品种相适应的药品配送系统
D. 具有负责网上实时咨询的执业药师
E. 对上网交易药品品种有完整的管理制度与措施

正确答案：B。获得国务院药品监管部门的批准

解析：本题考查向个人消费者提供互联网药品交易服务的企业应当具备的条件。根据《互联网药品交易服务审批暂行规定》，向个人消费者提供互联网药品交易服务的企业，应当具备的条件不包括获得国务院药品监管部门的批准（B错，为本题正确答案）。《互联网药品交易服务审批暂行规定》第九条：向个人消费者提供互联网药品交易服务的企业，应当具备以下条件：（一）依法设立的药品连锁零售企业（A对）；（二）提供互联网药品交易服务的网站已获得从事互联网药品信息服务的资格；（三）具有健全的网络与交易安全保障措施以及完整的管理制度；（四）具有完整保存交易记录的能力、设施和设备；（五）具备网上咨询、网上查询、生成订单、电子合同等基本交易服务功能；（六）对上网交易的品种有完整的管理制度与措施（E对）；（七）具有与上网交易的品种相适应的药品配送系统（C对）；（八）具有执业药师负责网上实时咨询（D对），并有保存完整咨询内容的设施、设备及相关管理制度；（九）从事医疗器械交易服务，应当配备拥有医疗器械相关专业学历、熟悉医疗器械相关法规的专职专业人员。